乳房自检早期发现乳腺癌
A. 第一级预防
B. 第二级预防
C. 第三级预防
D. 传染病的预防性措施
E. 传染病的防疫性措施

正确答案：B。第二级预防